蒽醌类化合物能溶于碳酸氢钠水溶液的原因之一是
A. 羧基
B. 1个α-羟基
C. 1个β-羟基
D. 2个α-羟基
E. 氨基

正确答案：A。羧基

解析：本题考查的是蒽醌类化合物的酸碱性。蒽醌类化合物能溶于碳酸氢钠水溶液的原因之一是羧基（A对）。蒽醌类衍生物多具有酚羟基，故具有酸性，易溶于碱性溶剂。分子中酚羟基的数目及位置不同，酸性强弱也不一样。其规律如下：1.带有羧基的蒽醌类衍生物酸性强于不带羧基者，一般蒽核上羧基的酸性与芳香酸相同，能溶于NaHCO₃水溶液。2.如羟基位于苯醌或萘醌的醌核上则属插烯酸结构，酸性与带羧基的蒽醌类衍生物类似。3.由于α-羟基蒽醌中的-OH与C=O形成分子内氢键，故β-羟基蒽醌的酸性强于α-羟基蒽醌衍生物。α-羟基蒽醌的酸性很弱，不但较苯酚及β-羟基蒽醌弱，且不及碳酸第一步解离时的酸性，故不溶解于碳酸氢钠及碳酸钠溶液。4.羟基数目越多，酸性越强。无论α位或β位，随着羟基数目的增加，其酸性都有一定程度的增加。如1，5与1，4-二羟基蒽醌虽各自均能形成氢键，但酸性仍有增加。1，8-二羟基蒽醌因两个羟基中只有一个与羰基形成氢键，故酸性大大增强，较碳酸第二步解离时的酸性高出近百倍，所以大黄酚能溶于沸碳酸钠溶液。综上所述，蒽醌类衍生物酸性强弱的排列顺序为：含-COOH＞含两个以上β-OH＞含一个β-OH（C错）＞含两个以上α-OH（D错）＞含一个α-OH（B错）。氨基（E错）为碱性基团，不利于蒽醌类化合物在碱溶液中的溶解。